循证医学中证据可分为五级，荟萃分析的结果属于
A. 一级证据
B. 二级证据
C. 三级证据
D. 四级证据
E. 五级证据

正确答案：A。一级证据

解析：本题考查荟萃分析的证据分级。荟萃分析一般指Meta分析。Meta分析（Meta-analysis）是用于比较和综合针对同一科学问题研究结果的统计学方法，是第一级证据（A对）。